女，16岁。反复左腰部胀痛不适2年，B超发现左肾积水6cm×4cm，上尿路未见结石，为明确病因最有价值的检查是
A. 腹部CT
B. 腹部X线平片
C. 静脉尿路造影
D. 左侧逆行肾盂造影
E. 放射性核素肾图

正确答案：C。静脉尿路造影

解析：青少年女性患者，左腰部胀痛不适，B超发现左肾积水6cm×4cm，上尿路未见结石，结合患者病史和相关检查，应诊断为左肾积水。为明确诊断，最有价值的检查是静脉尿路造影（IVU）（C对）。腹部CT（A错）能清楚显示肾积水程度和肾实质萎缩情况，但价格昂贵，一般不作为首选。腹部X线平片（B错）主要用于尿路结石的检查，一般不用于肾积水。逆行肾盂造影（D错）主要用于IVU患肾显影不清晰的患者。放射性核素肾图（E错）主要用于鉴别肾积水和肾囊肿。